病毒性肝炎对妊娠的影响，下述哪项是错误的
A. 妊娠早期患肝炎致畸发生率高
B. 妊娠早期患肝炎易发展为急性、亚急性肝炎
C. 妊娠晚期发病易并发妊高征
D. 妊娠中晚期发病易诱发DIC
E. 妊娠期发生病毒性肝炎致围生（产）儿死亡率高

正确答案：B。妊娠早期患肝炎易发展为急性、亚急性肝炎